关于蒸发浓缩下列说法错误的是
A. 升膜法适用于易结垢的物料
B. 降膜法适用于黏性大的物料
C. 刮膜法适用于黏性极大的物料
D. 多效蒸发器适用于易气泡、易跑料的物料
E. 离心蒸发法适用于高热敏性的物料

正确答案：A。升膜法适用于易结垢的物料

解析：本题考查的是蒸发浓缩。关于蒸发浓缩下列说法错误的是升膜法适用于易结垢的物料（A错，为本题正确答案）。降膜法适用于黏性大的物料（B对），刮膜法适用于黏性极大的物料（C对），多效蒸发器适用于易起泡、易跑料的物料（D对），离心蒸发法适用于高热敏性的物料（E对）。